Kennedy三类缺损者的义齿一般为
A. 牙支持式
B. 黏膜支持式
C. 混合支持式
D. 黏膜支持式或混合支持式
E. 不确定

正确答案：A。牙支持式

解析：牙支持式义齿两端基牙上均放置（牙合）支托和卡环，义齿的（牙合）力主要由天然牙承担；适用于少数牙缺失，或缺牙间隙小，缺隙两端均有基牙，且基牙稳固者。适用于Kennedy三类缺损者的义齿。掌握“局部义齿的设计”知识点。